奇静脉注入
A. 右心房
B. 头臂静脉
C. 上腔静脉
D. 下腔静脉
E. 锁骨下静脉

正确答案：C。上腔静脉

解析：上腔静脉（C对）为奇静脉在第4胸椎椎体高度的注入部位。